对铜绿假单胞菌有良好抗菌活性的药物是
A. 甲氧苄啶
B. 磺胺多辛
C. 呋喃唑酮
D. 磺胺嘧啶
E. 环丙沙星

正确答案：E。环丙沙星